关于上、下颌第二乳磨牙特点的叙述错误的是
A. 第二乳磨牙根干短，牙根向外张开
B. 第二乳磨牙的牙冠由颈部向（牙合）方扩大
C. 第二乳磨牙的牙冠颈部明显缩小，颈嵴较突
D. 下颌第二乳磨牙的近中、远中颊尖及远中尖的大小约相等
E. 第二乳磨牙的牙冠短小，色乳白

正确答案：B。第二乳磨牙的牙冠由颈部向（牙合）方扩大

解析：本题考查第二乳磨牙的形态特点。第二乳磨牙的牙冠由颈部向（牙合）方扩大（B错，为本题正确答案）不符合第二乳磨牙的特点。第二乳磨牙牙冠由颈部向牙合方聚拢，近颈部大而牙合面小。第二乳磨牙牙冠较第一恒磨牙小，呈乳白色（E对），近颈缘明显缩小，颈嵴突出（C对），下颌第二乳磨牙的近中、远中颊尖及远中尖的大小约相等（D对），而下颌第一恒磨牙此三尖中，近中颊尖＞远中颊尖＞远中尖。上颌第二乳磨牙为三根，下颌第二乳磨牙为二根，根干短，根分叉大（A对）。